肝门静脉是由
A. 肠系膜上、下静脉合成
B. 肝静脉和脾静脉合成
C. 脾静脉和肠系膜上静脉合成
D. 脾静脉和肠系膜下静脉合成
E. 由上述所有的静脉一起合成

正确答案：C。脾静脉和肠系膜上静脉合成

解析：脾静脉和肠系膜上静脉（C对）在胰颈后面合成肝门静脉。